错误的是
A. 连于鼓室与鼻咽之间
B. 是一条平衡气压的管道
C. 小儿短而宽近水平位
D. 分内2/3的骨部和外1/3的软骨部
E. 成人长而弯曲

正确答案：D。分内2/3的骨部和外1/3的软骨部

解析：咽鼓管是连通鼻咽部与鼓室（A对），以保持鼓膜内、外压力平衡（B对）的通道，分内2/3的软骨部和外1/3的骨部（D错，为本题正确答案），成人咽鼓管较幼儿长而弯曲（CE对）。